属于胰岛素增敏剂的是
A. 阿卡波糖
B. 二甲双胍
C. 罗格列酮
D. 西格列汀
E. 格列吡嗪

正确答案：C。罗格列酮

解析：本题考查罗格列酮。罗格列酮（C对）属于胰岛素增敏剂，通过增加骨骼肌、肝脏、脂肪组织对胰岛素的敏感性，提高细胞对葡萄糖的利用。阿卡波糖（A错）为α-葡萄糖甘酶抑制剂。二甲双胍（B错）通过促进组织对葡萄糖的摄取和利用，抑制葡萄糖在肠道的吸收，降低血糖。西格列汀（D错）为二肽基肽酶－4抑制剂。格列吡嗪（E错）为磺酰脲类促胰岛素分泌药。